男孩，1岁3个月。面色苍黄2个月，原可独走，现站立不稳，生后母乳喂养，未添加辅食。查体：表情呆滞，四肢抖动，舌苔薄，呈地图状。血常规：Hb88g/L，RBC2.1×10¹²/L。最有可能的诊断是
A. 缺铁性贫血
B. 营养性巨幼细胞性贫血
C. 苯丙酮尿症
D. 脑性瘫痪
E. 维生素D缺乏性手足搐搦症

正确答案：B。营养性巨幼细胞性贫血

解析：患儿1岁3个月，生后母乳喂养，未添加辅食（维生素B12摄入量不足），面色苍黄，站立不稳，表情呆滞，四肢抖动，舌苔薄，呈地图状（巨幼贫患儿典型临床表现），血常规：Hb88g/L，RBC2.1×10¹²/L（提示贫血）。根据患儿年龄、临床表现、体征及血常规，最可能的诊断是营养性巨幼细胞性贫血（B对）。缺铁性贫血（A错）与巨幼细胞性贫血临床表现类似，前者患儿面色苍白，可有反甲，异食癖等特有表现，后者患儿多面色蜡黄，严重患者神经精神症状明显。外周血、骨髓象血液检查易鉴别（P327）。苯丙酮尿症（C错）是常染色体隐性遗传疾病，临床以智力发育落后，皮肤、毛发色素浅淡和鼠尿臭味为主要特征 （P431）。维生素D缺乏性手足抽溺症（E错）多与患儿母亲妊娠期维生素D缺乏，摄入不足及日光照射不足等相关，临床表现早期有神经系统兴奋，如烦躁、多汗的表现；活动期表现随患儿生长发育、年龄不同而异，该年龄患儿可有“鸡胸样”畸形。查血清25-(OH）3降低可确诊（P75）。